某患儿，6岁。面色萎黄，形体消瘦，神疲肢倦，不思饮食，腹满喜按，大便稀溏，夹有未消化食物，舌质淡，苔白腻，脉滑。治宜选用的方剂是
A. 消乳丸
B. 健脾丸
C. 四物汤
D. 香连丸
E. 归脾汤

正确答案：B。健脾丸

解析：本题考查的是积滞的辨证论治。某患儿，6岁。面色萎黄，形体消瘦，神疲肢倦，不思饮食，腹满喜按，大便稀溏，夹有未消化食物，舌质淡，苔白腻，脉滑。治宜选用的方剂是健脾丸（B对）。积滞，是指小儿内伤乳食，停聚中焦，积而不化，气滞不行所致的疾病，以脘腹胀满、嗳气酸腐、不思乳食、食而不化、大便溏薄或秘结酸臭为临床特征。西医学的小儿消化不良表现为上述症状者，可参考此内容辨证论治。（一）乳食内积证：【症状】不思乳食，嗳腐酸馊，或呕吐食物、乳片，脘腹胀满疼痛，大便酸臭或便秘，烦躁啼哭，夜眠不安，手足心热。舌质红，苔白厚，或黄厚腻，脉弦滑，或指纹紫滞。【方剂应用】基础方剂为乳积用消乳丸（A错）（香附、神曲、麦芽、陈皮、砂仁、甘草）加减；食积用保和丸（山楂、神曲、半夏、茯苓、陈皮、连翘、莱菔子）加减。（二）脾虚夹积证：【症状】面色萎黄，形体消瘦，神疲肢倦，不思乳食，食则饱胀，腹满喜按，大便溏稀酸腥，夹有乳片或不消化食物残渣。舌质淡，苔白腻，脉细滑，或指纹淡滞。【方剂应用】基础方剂为健脾丸（人参、白术、陈皮、麦芽、山楂、神曲、枳实）加减。四物汤（C错）为虚劳血虚证的方剂应用。虚劳血虚证：【症状】头晕眼花，心悸多梦，手足发麻，面色淡黄或淡白无华，口唇、爪甲色淡，妇女月经量少。舌质淡，脉细。【方剂应用】基础方剂为四物汤（熟地黄、当归、川芎、芍药）加减。香连丸（D错）为泄泻湿热伤中证的中成药应用。泄泻湿热伤中证：【症状】泄泻腹痛，泻下急迫，势如水注，或泻而不爽，粪色黄褐，气味臭秽，肛门灼热，烦热口渴，小便短黄。舌质红，苔黄腻，脉滑数或濡数。【方剂应用】基础方剂为葛根芩连汤（葛根、黄芩、黄连、甘草）加减。归脾汤（E错）为心悸心脾两虚证的方剂应用。心悸心脾两虚证：【症状】心悸气短，头晕目眩，失眠健忘，面色无华，倦怠乏力，纳呆食少。舌淡红，脉细弱。【方剂应用】基础方剂为归脾汤（人参、黄芪、白术、茯神、龙眼肉、酸枣仁、木香、当归、远志、甘草、生姜、大枣）加减。